男性，25岁。骑跨式会阴部外伤后不能自行排尿，会阴部青紫合并阴囊血肿，导尿管不能插入膀胱。多为
A. 阴囊损伤
B. 阴茎部尿道损伤
C. 尿道球部损伤
D. 后尿道损伤
E. 膀胱损伤

正确答案：C。尿道球部损伤

解析：青年男性患者，骑跨式会阴部外伤后不能自行排尿（提示可能有尿道损伤），导尿管不能插入膀胱（提示尿道断裂），会阴部青紫并阴囊血肿（提示为前尿道损伤），结合患者病史和临床表现，诊断考虑尿道球部损伤（C对）。阴囊损伤（A错）主要表现为阴囊肿胀、疼痛，不会出现尿道断裂，排尿及导尿一般不受影响。阴茎部尿道损伤（B错）一般较少见。后尿道损伤（D错）多见于骨盆骨折，尿液可外渗致耻骨后间隙和膀胱周围，因下方有尿生殖膈阻挡，尿液一般不会外渗至会阴部及阴囊、阴茎。膀胱损伤（E错）时尿道完整，导尿管多能顺利插入膀胱。